某女，18岁，今年如愿考上了大学，参加新生体检时，身高160cm，体重75kg。其体质量指数（BMI）为
A. 146.5
B. 95
C. 40.6
D. 29.3
E. 25.4

正确答案：D。29.3